下列领域中是最早出现生命质量这一术语的是
A. 心理学
B. 自然科学
C. 生命科学
D. 社会学
E. 医学

正确答案：D。社会学

解析：本题考查生命质量的最初来源。最早出现生命质量这一术语的是社会学（D对ABCE错）领域。